唾液中所含的缓冲物质为
A. 碳酸盐和重碳酸盐
B. 碳酸盐和蛋白缓冲系统
C. 重碳酸盐和磷酸盐
D. 重碳酸盐、磷酸盐和蛋白缓冲系统

正确答案：D。重碳酸盐、磷酸盐和蛋白缓冲系统

解析：本题考查唾液缓冲系统。唾液中3个主要缓冲系统使唾液pH处于中性，包括重碳酸盐、磷酸盐和蛋白缓冲系统（D对ABC错），这3个系统对pH变化有不同的缓冲能力。重碳酸盐缓冲系统和磷酸缓冲系统的pH分别为6.1～6.3和6.8～7.0。在咀嚼和进食时唾液的缓冲能力主要依靠重碳酸盐缓冲系统，其缓冲能力占唾液缓冲能力的64%～90%。在非刺激状态，唾液中重碳酸盐的浓度很低，唾液的缓冲力弱。若刺激唾液分泌，重碳酸盐的含量增多，唾液pH上升，当唾液流速增加到1mL/min时，重碳酸盐的浓度上升到30～60mmol/L，发挥缓冲作用。重碳酸盐还可扩散入牙菌斑生物膜，中和细菌产生的酸。